肺痈溃脓期的治法是
A. 清肺化瘀消痈
B. 养阴补肺消痈
C. 清肺解表
D. 排脓解毒
E. 清热解毒

正确答案：D。排脓解毒

解析：肺痈溃脓期的病机为热壅血瘀，血败肉腐，痈脓内溃外泄，为热毒壅盛所致，故治宜排脓解毒（D对）。清肺化瘀消痈为肺痈成痈期的治法（A错）。养阴补肺消痈不适用于肺痈的治疗，肺痈有痈当以消痈为主，不能消补兼施（B错）。清肺解表适用于肺痈初期（C错）。清热解毒常用于治疗热毒炽盛证，如疮疡、温毒等（E错）。